某女，45岁。患痰火郁结之瘿瘤数年，近一周出现肝阳眩晕与目珠夜痛，治当清肝明目，散结消肿，宜选用的药物是
A. 谷精草
B. 天花粉
C. 密蒙花
D. 夏枯草
E. 决明子

正确答案：D。夏枯草

解析：本题考查的是夏枯草的功效。患痰火郁结之瘿瘤数年，近一周出现肝阳眩晕与目珠夜痛，治当清肝明目，散结消肿，宜选用的药物是夏枯草（D对）。夏枯草：【功效】清肝明目，散结消肿。谷精草（A错）：【功效】疏散风热，明目退翳。天花粉（B错）：【功效】清热生津，清肺润燥，消肿排脓。密蒙花（C错）：【功效】清热养肝，明目退翳。决明子（E错）：【功效】清肝明目，润肠通便。